关于肿瘤免疫反应描述正确的是
A. 体液免疫在抗肿瘤免疫中起主要作用
B. 细胞免疫在抗肿瘤免疫中起主要作用
C. 静止的与活化的MΦ均能杀伤肿瘤细胞
D. 诊断主要依赖于肿瘤的特异性抗原的检测
E. 临床使用细胞因子治疗肿瘤效果显著

正确答案：B。细胞免疫在抗肿瘤免疫中起主要作用